磺胺类可促进
A. 疟原虫生长
B. 立克次体生长
C. 肺炎链球菌生长
D. 沙眼衣原体生长
E. 淋病奈瑟菌生长

正确答案：B。立克次体生长

解析：磺胺类对支原体、立克次体和螺旋体无效，甚至可促进立克次体生长。掌握“磺胺类及甲硝唑”知识点。